夜间咳嗽、咳痰比较明显者见于
A. 肺炎
B. 肺结核
C. 喉炎
D. 肺癌
E. 胸膜炎

正确答案：B。肺结核

解析：夜间咳嗽、咳痰比较明显者见于肺结核（B对）和左心衰竭，可能与夜间肺淤血加重和迷走神经兴奋性增高有关。肺炎（A错）、喉炎（C错）、肺癌（D错）患者咳嗽、咳痰多无时间规律。胸膜炎（E错）患者可出现咳嗽伴发热，较少咳痰。